对学龄儿童进行营养不良筛查时，应先后采用什么方法对其营养不良的情况进行评价
A. 年龄别体重、身高别体重
B. 年龄别体重、年龄别身高
C. 年龄别身高、身高别体重
D. 年龄别身高、年龄别体重
E. 身高别体重、年龄别体重

正确答案：C。年龄别身高、身高别体重